听区位于
A. 颞上回
B. 颞下回
C. 颞横回
D. 角回
E. 无

正确答案：C。颞横回

解析：听区位于颞横回（C对）。